继发性不孕最常见的原因
A. 阴道因素
B. 宫体因素
C. 宫颈因素
D. 输卵管因素
E. 精神因素

正确答案：D。输卵管因素

解析：导致女性不孕的因素中，最常见的是输卵管因素（D对），精神因素（E错）、外阴、阴道因素（A错）、宫颈病变（C错）、宫体因素（B错）等也可导致女性不孕，但不是最常见原因。